不属于弥漫性结缔组织病的是
A. 皮肌炎
B. 类风湿关节炎
C. 强直性脊柱炎
D. 系统性红斑狼疮
E. 干燥综合征

正确答案：C。强直性脊柱炎

解析：强直性脊柱炎（C错，为本题正确答案）属于脊柱关节病，不属于弥漫性结缔组织病。弥漫性结缔组织病包括类风湿性关节炎（B对）、系统性红斑狼疮（D对）、硬皮病、多肌炎、皮肌炎（A对）、干燥综合征（E对）、血管炎病等。